正常思维一般都具有
A. 目的性
B. 连贯性
C. 逻辑性
D. 实践性
E. 以上都对

正确答案：E。以上都对

解析：按照第六版医学心理学概念，间接性和概括性是思维过程的主要特征。此题为往年题目，参考即可。思维是人脑间接地概括地对客观事物的反映。思维的间接性表现在它是借助其他事物为媒介间接地认识事物。思维的概括性表现两个方面，一是对一类事物共同本质特征概括性的认识，二是对事物之间规律性的内在联系的认识。